属于水肿心败不治的是
A. 面肿苍黑
B. 掌肿无纹理
C. 阴肿不起
D. 腰肿无纹理
E. 脐满反肿

正确答案：B。掌肿无纹理

解析：唐代名医孙思邈在《备急千金要方·水肿》中提出水肿必须忌盐，并指出水肿有五不治：“一、面肿苍黑，是肝败不治（A错）；二、掌肿无纹理，是心败不治（B对）；三、腰肿无纹理，是肺损不治（D错）；四、阴肿不起者，是肾败不治（C错）；五、脐满反肿者，是脾败不治（E错）。”